1个月的小儿应接种的疫苗是
A. 卡介苗
B. 乙肝疫苗
C. 脊髓灰质炎疫苗
D. 麻疹疫苗
E. 百白破混合制剂

正确答案：B。乙肝疫苗

解析：本题考查1月龄的小儿应接种的疫苗。乙肝疫苗（B对）共接种3剂次，其中第1剂在新生儿出生后24小时内接种，第2剂在1月龄时接种，第3剂在6月龄时接种。卡介苗（A错）出生时接种1剂。脊髓灰质炎疫苗（C错）共接种4剂次，其中2月龄接种1剂灭活脊灰疫苗（IPV），3、4月龄和4周岁各接种1剂脊灰减毒活疫苗（OPV）。麻疹疫苗（D错）8月龄接种l剂。百白破混合制剂（E错）共接种4剂次，分别于3、4、5、18月龄各接种1剂。